甲状腺次全切手术后出现手足抽搐，可能是
A. 喉头血肿导致窒息
B. 继发肾上腺损伤
C. 切除了甲状旁腺
D. 甲状腺功能低下
E. 损伤了甲状腺神经

正确答案：C。切除了甲状旁腺

解析：甲状旁腺分泌甲状旁腺素，主要作用是调节体内钙和磷的代谢。甲状旁腺位于甲状腺左、右侧叶的后面，甲状腺手术中易被误切，切除了甲状旁腺（C对）导致甲状旁腺激素分泌不足，从而引起血钙降低，机体发生酸中毒，从而导致中枢神经和肌肉的功能紊乱，出现手足抽搐。